通过抗氧化作用，抑制OX-LDL生成而抗动脉粥样硬化的药物是
A. 辛伐他汀
B. 考来烯胺
C. 普罗布考
D. 烟酸
E. 吉非贝齐

正确答案：C。普罗布考

解析：本题考查普罗布考的作用机制。普罗布考（C对）属于抗氧化剂类抗动脉粥硬化药，通过抗氧化作用，抑制OX-LDL生成而抗动脉粥样硬化。